能够减轻梗阻性肥厚型心肌病的左心室流出道梗阻可以使用的药物是
A. β受体阻滞剂
B. 硝酸甘油
C. 地高辛
D. 异丙肾上腺素
E. 去甲肾上腺素

正确答案：A。β受体阻滞剂

解析：β受体阻滞剂可减轻梗阻性肥厚型心肌病的左心室流出道梗阻（A对）。